诊断冠心病最常用的非创伤性检查方法是
A. 休息时心电图
B. 24小时动态心电图
C. 心电图运动负荷试验
D. 超声心动图
E. 心脏CT检查

正确答案：C。心电图运动负荷试验

解析：心电图运动负荷试验（C对）是最常用的心电图负荷试验，主要机制是增加心脏负荷以激发心肌缺血。运动中可出现典型心绞痛，心电图改变主要以ST段水平型或下斜型压低≥0.1mV（J点后60～80ms）持续2分钟为运动试验阳性标准，是诊断冠心病最常用的非创伤性检查方法。但需注意单纯运动心电图阳性或阴性结果不能作为诊断或排除冠心病的依据。心电图是发现心肌缺血、诊断心绞痛最常用的检查方法，其中休息时心电图（A错）约半数患者在正常范围。而24小时动态心电图（P159）（B错）主要用于一过性心律失常及短暂的心肌缺血发作。超声心动图（D错）主要用于心脏和大血管的解剖结构及功能状态的诊断性检查，对冠心病的诊断意义不大。心脏CT检查（P160）（E错）是筛查和诊断冠心病的重要手段，但其价格昂贵，操作较复杂，因此并非最佳答案。